酚污染能使水的感官性状恶化，苯酚的氯酚臭阈为
A. 0.1mg/L
B. 0.01mg/L
C. 0.001mg/L
D. 0.005mg/L
E. 0.002mg/L

正确答案：D。0.005mg/L

解析：本题考查酚的相关内容。酚类污染水体可使水的感官性状明显恶化，可使鱼贝类水产品带有异臭异味。此外，当以含酚类化学物污染的水体为水源生产自来水，并以氯消毒时，水中的酚类化合物可与水中游离氯结合产生氯酚，由于氯酚的臭阈低至0.005mg/L（D对ABCE错），氯酚臭产生明显的异味，引起感官性状不良反应。